九气拈痛丸的功能是
A. 理气，宽胸，止痛
B. 益气养阴，活血通络，清心安神
C. 益气复脉，活血化瘀，养阴生津
D. 理气，活血，止痛
E. 破血逐瘀，通络止痛

正确答案：D。理气，活血，止痛

解析：本题考查的是九气拈痛丸的功能。九气拈痛丸的功能是理气，活血，止痛（D对）。九气拈痛丸：【功能】理气，活血，止痛。冠心苏合滴丸：【功能】理气，宽胸，止痛（A错）。参松养心胶囊：【功能】益气养阴，活血通络，清心安神（B错）。益心舒胶囊：【功能】益气复脉，活血化瘀，养阴生津（C错）。功能为破血逐瘀，通络止痛（E错）的中成药，2022年考试指南未明确说明。